常引起光变应性接触性皮炎的化妆品是
A. 护肤霜
B. 香粉
C. 爽身水
D. 烫发剂
E. 防晒霜

正确答案：E。防晒霜

解析：本题考查常引起光变应性接触性皮炎的化妆品。光变应性接触性皮炎指局部使用含有光变应原物质的化妆品后，在接触日光的部位出现皮肤炎症反应，而不接触光的皮肤则不出现此种反应。防晒霜（E对ABCD错）中的对氨基甲酸及其酯类物质是一种光变应原，皮肤使用含有光变应原的防晒霜，只要一次接触阳光，即可发生光变应性接触性皮炎并可持续一周左右。